杏仁的不良反应是
A. 恶心、呕吐、紫绀、昏迷
B. 咽喉肿胀、疼痛
C. 失音、流涎
D. 心动过速
E. 皮肤瘙痒

正确答案：A。恶心、呕吐、紫绀、昏迷

解析：本题考查的是中药饮片的不良反应。杏仁的不良反应是恶心、呕吐、紫绀、昏迷（A对）。苦杏仁不良反应表现：苦杏仁的主要成分苦杏仁苷是其有效成分也是中毒成分，误服过量苦杏仁可发生氢氰酸中毒，使延髓等生命中枢先抑制后麻痹，并抑制细胞色素氧化酶的活性而引起组织窒息。临床表现为眩晕、心悸、恶心、呕吐等中毒反应，重者出现昏迷、惊厥、瞳孔散大、对光反应消失，最后因呼吸麻痹而死亡。咽喉肿胀、疼痛（B错）与失音、流涎（C错）为生半夏的不良反应。半夏辛温有毒，生用能使人呕吐、咽喉肿痛或失音。心动过速（D错）为胆矾的不良反应表现。胆矾的不良反应表现：①消化系统：流涎、恶心、呕吐、腹痛、腹泻、呕血、便血等，口涎、呕吐物、粪便多呈蓝绿色，口中有特殊金属味；黄疸、中毒性肝炎等症状。②血液系统：溶血性贫血。③泌尿系统：蛋白尿、血尿、少尿、无尿、氮质血症、急性肾功能衰竭或尿毒症等。④循环系统：血管麻痹、血压下降。铜离子对心脏损害可引起中毒性心肌炎，表现心动过速、心律失常及心力衰竭。⑤神经系统：头痛头晕、全身乏力，严重者出现脑水肿、痉挛、神经麻痹、谵妄、意识障碍等中毒性脑炎症状。皮肤瘙痒（E错）为黄药子的不良反应表现。黄药子的不良反应表现：目前临床报道的与黄药子及其制剂相关的安全性问题主要是肝毒性，且有死亡病例发生。其肝损害的临床表现，以混合性损伤为主，兼有肝细胞损伤和胆汁淤积的症状，且损伤程度和剂量与给药时间有关。实验室检查血ALT、AST、STB等显著升高。一般常见症状为乏力、纳差、尿黄、头晕、厌油腻，有的伴有巩膜、皮肤黄染，瘙痒，大便灰白等，严重者表现为急性肝炎等，有的患者伴有胆囊炎。大剂量服用可引起恶心、呕吐、脱发等症状。文献报道黄药子亦可引起肾损害和甲状腺损害，临床应用过程中应注意加强监测。